过敏性紫癜（单纯型）紫癜出现后一般多长时间消退
A. 1周
B. 1～2周
C. 1～3周
D. 3～4周
E. 4周以上

正确答案：B。1～2周

解析：过敏型紫癜（单纯型），主要表现为皮肤紫癜，经过7～14日逐渐消退。掌握“过敏性紫癜”知识点。